活体体表可触摸到搏动的动脉，不包括以下的
A. 肱动脉
B. 面动脉
C. 颈总动脉
D. 足背动脉
E. 椎动脉

正确答案：E。椎动脉

解析：肱动脉（A对）可在肱二头肌内侧沟处触知其搏动。面动脉（B对）在咬肌前缘绕下颌骨下缘处可摸到其搏动。颈总动脉上段（C对）在活体上可摸到其搏动。足背动脉在踝关节的前方，内、外踝前方连线的中点、踇长伸肌腿的外侧可触知其搏动（D对E错，为本题正确答案）。